影响化学毒物毒性大小和毒作用性质的决定因素是化学毒物的
A. 化学结构和理化性质
B. 吸收途径
C. 剂量
D. 作用时间

正确答案：A。化学结构和理化性质

解析：本题考查影响化学毒物毒性大小和毒作用性质的决定因素。影响化学毒物毒性大小和毒作用性质的决定因素是化学毒物的化学结构和理化性质（A对BCD错）。